肠结核的主要感染途径是
A. 经口
B. 经血液
C. 经淋巴液
D. 腹腔病变直接蔓延
E. 腰椎病变直接蔓延

正确答案：A。经口

解析：肠结核多因患开放性肺结核或喉结核而吞下含菌痰液、或常与开放性肺结核患者共餐而忽视餐具消毒等而被感染，主要感染途径是经口感染（A对）。少数患者也可经血液循环（B错）或经腹腔病变直接蔓延（D错）引起。经淋巴液（C错）和经血液循环（B错）感染常见于原发性肺结核（P63）。腰椎病变直接蔓延感染（E错）常见于边缘性脊柱结核（九版外科学P753）。